后溪通的是奇经八脉中的
A. 阳跷脉
B. 督脉
C. 阳维脉
D. 任脉
E. 带脉

正确答案：B。督脉

解析：后溪穴为八脉交会穴，通于督脉（B对）；外关通于阳维脉（C错）；列缺通于任脉（D错）；足临泣通于带脉（E错）。